单剂量固体药物需要进行的检查项目是
A. 熔点
B. 有关物质
C. 含量均匀度
D. 干燥失重
E. 溶解度

正确答案：C。含量均匀度

解析：本题考查含量均匀度检查。单剂量固体、半固体和非均相液体制剂含量均需要检查含量均匀度（C对）。